具有初级专业技术职务任职资格的医师，在乡、民族乡、镇、村的医疗机构独立从事一般执业活动的执业助理医师以及乡村医生可授予
A. 一级使用级抗菌药物处方权
B. 备用使用级抗菌药物处方权
C. 特殊使用级抗菌药物处方权
D. 限制使用级抗菌药物处方权
E. 非限制使用级抗菌药物处方权

正确答案：E。非限制使用级抗菌药物处方权

解析：具有初级专业技术职务任职资格的医师，在乡、民族乡、镇、村的医疗机构独立从事一般执业活动的执业助理医师以及乡村医生，可授予非限制使用级抗菌药物处方权。药师经培训并考核合格后，方可获得抗菌药物调剂资格。掌握“抗菌药物临床应用、监督及法律责任”知识点。